以下哪项不属于医学道德教育的方法
A. 案例讨论，以理导人
B. 个别引导、以法育人
C. 多加开导，以理服人
D. 积极疏导、以情动人
E. 舆论扬抑，以境育人

正确答案：C。多加开导，以理服人

解析：医学道德教育的方法：案例讨论，以理导人；积极疏导、以情动人；积极疏导、以情动人；舆论扬抑，以境育人。